农民肺属于职业性变态反应性肺泡炎，引起农民肺的粉尘是
A. 棉、麻等植物性粉尘
B. 霉变枯草粉尘
C. 田间飞扬的粉尘
D. 粮谷粉尘
E. 飞扬的人畜粪肥粉尘

正确答案：B。霉变枯草粉尘